规定的观察期内某病患者中因该病而死亡的频率是
A. 发病率
B. 患病率
C. 某病病死率
D. 某病死亡率
E. 治愈率

正确答案：C。某病病死率